慢性阻塞性腮腺炎最常见的病因是
A. 导管较长导致的唾液滞留
B. 导管口黏膜损伤致导管口狭窄
C. 导管异物
D. 导管结石
E. 增龄性改变，导致唾液瘀滞

正确答案：B。导管口黏膜损伤致导管口狭窄

解析：本题考查慢性阻塞性腮腺炎最常见的病因。慢性阻塞性腮腺炎表现为腮腺的反复肿胀，大多数患者是由局部原因引起的，如智牙萌出时，导管口黏膜损伤致导管口狭窄（B对），这也是慢性阻塞性腮腺炎最常见的病因。导管较长导致的唾液滞留（A错）是造成阻塞性腮腺炎的病因之一，但不是最常见的。导管异物（C错）、导管结石（D错）也是较少见的病因。增龄性改变，导致唾液瘀滞（E错）但不会引起慢性阻塞性腮腺炎。